抽样单位为群体，再从群体中随机抽样的方法称为
A. 单纯随机抽样
B. 系统抽样
C. 分层抽样
D. 整群抽样
E. 多级抽样

正确答案：E。多级抽样